具有强大的抗炎及免疫抑制作用的，用于哮喘发作的药物是
A. 二丙酸倍氯米松
B. 可待因
C. 沙丁胺醇
D. 氨茶碱
E. 色甘酸钠

正确答案：A。二丙酸倍氯米松

解析：本题考查二丙酸倍氯米松。糖皮质激素二丙酸倍氯米松（A对）具有强大的抗炎及免疫抑制作用，主要用于其它药物无效的慢性支气管哮喘患者。可待因（B错）为中枢性镇咳药，多用于无痰干咳。平喘药沙丁胺醇（C错）为选择性β₂受体激动剂，主要作用于呼吸道平滑肌和肥大细胞等细胞膜表面的β₂受体，支气管扩张作用明显。临床用于缓解支气管哮喘、哮喘型支气管炎和肺气肿等患者的支气管痉挛急性症状。氨茶碱（D错）为磷酸二脂酶抑制剂，通过抑制磷酸二酯酶，从而提高平滑肌细胞内cAMP或cGMP的浓度。临床上用于支气管哮喘、喘息性支气管炎、慢性阻塞性肺病，也可用于急性心功能不全和心源性哮喘等。色甘酸钠（E错）为肥大细胞膜稳定剂，临床主要用于预防哮喘发作。